在德国莱比锡大学建立世界上第一所心理实验室，使心理学成为科学的学科创建者是
A. 韦伯
B. 卡特尔
C. 比奈
D. 冯特
E. 费希纳

正确答案：D。冯特

解析：冯特在德国建立了世界上第一所心理实验室。